关于皮质脊髓束说法错误的是
A. 其细胞体位于全部中央前回和旁中央小叶前部
B. 经过内囊后肢下行
C. 在脑干的腹侧部下行
D. 大部纤维经锥体交叉,交叉至对侧下行
E. 小部纤维经锥体不交叉在同侧下行

正确答案：A。其细胞体位于全部中央前回和旁中央小叶前部

解析：皮质脊髓束由中央前回上、中部和中央旁小叶前半部等处皮质的锥体细胞轴突集中而成（A错，为本题正确选项）。经过内囊后肢（B对），在脑干的腹侧部下行（C对），75% -90%的纤维交叉至对侧，形成锥体交叉（DE对）。